筛检试验在下列哪种情况是最适宜的
A. 患病率高的疾病
B. 患病率低的疾病
C. 早期诊断可改善预后的疾病
D. 病情严重，难以治愈的疾病
E. 病死率较高的疾病

正确答案：C。早期诊断可改善预后的疾病